迎香穴位于
A. 鼻孔外缘，旁开0.5寸
B. 鼻翼外缘，旁开0.5寸
C. 鼻翼外缘中点，旁开0.5寸
D. 鼻翼上缘中点，旁开0. 5寸
E. 平鼻孔，当鼻唇沟中

正确答案：C。鼻翼外缘中点，旁开0.5寸

解析：该题考查迎香穴的定位。迎香穴（手阳明大肠经）位于鼻翼外缘中点旁开约0.5寸，当鼻唇沟中（C对ABDE错）。